对药物在更广泛的人群、更复杂的用药条件、更长期的用药时间、更多样的用药方案以及用药时与停药后的各项临床指标进行监察的过程，称为
A. 临床前试验
B. Ⅰ期临床试验
C. Ⅱ期临床试验
D. Ⅲ期临床试验
E. 上市后再评价

正确答案：E。上市后再评价

解析：本题考查药物评价。药物的临床评价可分为上市前评价、上市后再评价两个阶段。治疗药物的有效性和安全性评价是药物评价的关键要素，新药按照《药物临床试验质量管理规范》要求必须经过四期的临床试验，即上市前要经过三期（Ⅰ期、Ⅱ期和Ⅲ期）临床试验（BCD错）；批准上市后还要经过Ⅳ期临床试验。上市后再评价（E对）是对药物在更广泛的人群、更复杂的用药条件、更长期的用药时间、更多样的用药方案以及用药时与停药后的各项临床指标进行监察，这样的评价既包括临床试验完成的“新药”，也包括所有在市场上销售的“老药”；广义的上市后再评价是贯穿于药物的整个生命过程中的评价。